患者恶寒无汗，咳嗽痰稀，鼻塞咽干，苔白，脉弦，治疗应首选的方剂是
A. 桑杏汤
B. 清燥救肺汤
C. 止嗽散
D. 杏苏散
E. 养阴清肺汤

正确答案：D。杏苏散

解析：患者恶寒无汗，咳嗽痰稀，苔白，提示病性为风寒，病位在肺；鼻塞咽干，提示肺失润养，故当治以辛温疏风散寒，宣肺止咳化痰，兼以滋阴润肺，首选轻宣凉燥，理肺化痰的杏苏散（D对）。桑杏汤为风燥伤肺证之外感咳嗽的代表方（A错）。清燥救肺汤治温燥伤肺（B错）。止嗽散以疏风润肺为主，用于咳嗽迁延不愈或愈而复发者（C错）。养阴清肺汤为白喉的代表方（E错）。